关于医学实践与医学伦理学的关系，下列说法中错误的是
A. 医学实践是医学伦理学的理论指导
B. 医学实践是医学伦理学的基础
C. 医学实践是医学伦理学的动力
D. 医学实践是医学伦理学的目的
E. 医学实践是检验医学伦理学的唯一标准

正确答案：A。医学实践是医学伦理学的理论指导

解析：医学伦理学属于应用伦理学的范畴，其理论和规范都来源于实践，其在长期的医疗活动中形成和发展，是对医学实践中的道德关系、道德意识和道德行为的概括和说明。医学实践与医学伦理学的关系：①医学伦理学是医学实践的理论指导（A错，为本题正确选项）：②医学实践是医学伦理学的基础（B对）：③医学实践是医学伦理学的动力（C对）：④医学实践是医学伦理学的目的（D对）：⑤医学实践是检验医学伦理学的唯一标准（E对）。